可用于检查的杂质为：在酸性溶液中与氯化钡生成浑浊液的方法
A. 氯化物
B. 砷盐
C. 铁盐
D. 硫酸盐
E. 重金属

正确答案：D。硫酸盐